典型支气管哮喘发作时最主要的临床表现为
A. 吸气性呼吸困难，双肺哮鸣音
B. 呼气性呼吸困难，双肺哮鸣音
C. 端坐呼吸，双肺密布中小水泡音
D. 呼气性呼吸困难，双肺散在干、湿啰音
E. 进行性呼气性呼吸困难，肺部局限性哮喘

正确答案：B。呼气性呼吸困难，双肺哮鸣音

解析：支气管哮喘的典型症状为伴有哮鸣音的呼气性呼吸困难，症状可在数分钟内发生，并持续数小时至数天，可经平喘药物治疗后缓解或自行缓解（B对）。吸气性呼吸困难，双肺哮鸣音（A错）是大支气管狭窄、大支气管梗阻的症状。端坐呼吸，双肺密布中小水泡音（C错）是左心衰竭时肺水肿的临床表现。呼气性呼吸困难双肺散在干湿啰音（D错）是慢性支气管炎的临床表现。进行性呼吸困难，肺部局限性哮喘（E错）是支气管肿瘤的临床表现。